妇女更年期体内性激素水平变化特点是
A. 雌激素下降，孕激素下降，促性腺激素升高
B. 雌激素升高，孕激素升高，促性腺激素下降
C. 雌激素下降，孕激素升高，促性腺激素下降
D. 雌激素升高，孕激素下降，促性腺激素升高
E. 雌激素下降，孕激素下降，促性腺激素下降

正确答案：A。雌激素下降，孕激素下降，促性腺激素升高

解析：本题考查妇女更年期体内性激素水平变化特点。妇女进入更年期后，随着卵巢卵泡数目的不断减少和分泌功能下降，使机体内雌激素和孕激素水平逐渐降低，这种降低使对下丘脑和垂体的抑制作用减弱，从而导致了下丘脑分泌促性腺激素释放激素（GnRH）功能增强和垂体对GnRH的反应性增高（A对BCDE错），使垂体分泌的促卵泡生长激素（FSH）和促黄体生成激素（LH）的水平升高。